下列药品中，没有纳入《抗菌药物临床应用管理办法》适用范围的是
A. 治疗真菌所致感染性疾病的药品
B. 治疗衣原体所致感染性疾病的药品
C. 治疗螺旋体所致感染性疾病的药品
D. 治疗结核杆菌所致感染性疾病的药品
E. 治疗立克次体所致感染性疾病的药品

正确答案：D。治疗结核杆菌所致感染性疾病的药品

解析：本题考查的是抗菌药物的定义。下列药品中，没有纳入《抗菌药物临床应用管理办法》适用范围的是治疗结核杆菌所致感染性疾病的药品（D错，为本题正确答案）。抗菌药物的定义：《抗菌药物临床应用管理办法》所称抗菌药物是指治疗细菌、支原体、衣原体、立克次体、螺旋体、真菌等病原微生物所致感染性疾病病原的药物（ABCE对），不包括治疗结核病、寄生虫病和各种病毒所致感染性疾病的药物以及具有抗菌作用的中药制剂。